以下哪项不是可摘局部义齿的组成成分
A. 固位体
B. 基牙
C. 人工牙
D. 基托
E. 连接体

正确答案：B。基牙

解析：本题考查可摘局部义齿的组成成分。基牙（B错，为本题的正确答案）则是天然牙预备而成，可以进行全冠或者固定桥修复，在固定局部义齿中，基牙的主要功能是支持固定桥，负担着基牙自身和桥体额外的力。固位体（A对）是可摘局部义齿以抵抗脱位力作用，获得固位、支持与稳定的重要作用。连接体（E对）是可摘局部义齿的重要组成部分，分大连接体和小连接体两类，将义齿各部分连接到一起同时还有传递和分散牙合力的作用。基托（D对）是可摘局部义齿的重要组成部分之一，覆盖在缺牙区牙槽嵴及相关的牙槽嵴唇颊舌侧及硬腭上区，主要作用是供人工牙排列附着，传导分散咬合力到其下的支持组织，并能把义齿的各部分连成一个整体。人工牙（C对）是义齿结构上用以代替缺失的天然牙，以恢复牙冠形态和咀嚼功能的部分。固位体、人工牙、基托和连接体均属于可摘局部义齿的组成成分。